代谢性碱中毒伴有的电解质紊乱是
A. 低钾血症
B. 高钾血症
C. 镁缺乏
D. 高钙血症
E. 高钠血症

正确答案：A。低钾血症

解析：代谢性碱中毒时，H⁺进入细胞内减少，K⁺从细胞内移至细胞外减少，从而导致低钾血症（A对B错）。代谢性碱中毒主要是氯离子、钾离子和氢离子丢失，对镁离子（C错）、钙离子（D错）和钠离子（E错）浓度无明显影响。